下列哪项不是队列研究的特点
A. 属观察法
B. 必须设立对照
C. 由“因”及“果”
D. 不能确证因果联系

正确答案：D。不能确证因果联系

解析：本题考查队列研究的特点。队列研究属于观察法（A对），必须设立对照组（B对），是一种由因及果（C对）的研究。队列研究由于病因发生在前，疾病发生在后，因果现象发生的时间顺序是合理的，加之偏倚较少，又可直接计算各项测量疾病危险强度的指标，故其检验病因假说的能力较强，一般可证实病因联系（D错，为本题正确答案）。